下列对一般性感觉描述不正确的是
A. 是生命质量评价中最为敏感的指标
B. 与个人的文化背景和价值观念的关系极为密切
C. 可分为健康自评和自我生活评价
D. 是生命质量评价中较为主观的指标
E. 是指个人对其健康状况、生活状况作出的自我评判

正确答案：A。是生命质量评价中最为敏感的指标

解析：本题考查一般性感觉。一般性感觉是指个人对其健康状况、生活状况作出的自我评判（E对），它与个人的文化背景和价值观念的关系极为密切（B对）。一般性感觉可分为健康自评和自我生活评价（C对），是生命质量评价中较为主观（A错，为本题正确答案）的指标（D对）。